同时具有伸肘、伸腕和伸指作用的肌是
A. 拇长伸肌
B. 指伸肌
C. 桡侧腕长伸肌
D. 小指伸肌
E. 尺侧腕伸肌

正确答案：B。指伸肌

解析：指伸肌（B对）同时具有伸肘、伸腕和伸指作用。拇长伸肌（A错）伸拇指。桡侧腕长伸肌（C错）伸和外展腕。小指伸肌（D错）伸小指。尺侧腕伸肌（E错）伸和内收腕。